不会导致全冠粘固后出现龈缘炎的是
A. 轴壁突度不良
B. 咬合早接触
C. 冠边缘不密合
D. 龈沟内粘固剂残留
E. 冠边缘过长

正确答案：B。咬合早接触

解析：本题考查修复体戴入后的问题及处理。不会导致全冠粘固后出现龈缘炎的是咬合早接触（B错，为本题正确答案）。修复体粘固后出现龈缘炎的原因。①修复体轴壁突度不良（A对），如短冠修复体轴壁突度不足，食物冲击牙龈。②冠边缘过长（E对），边缘抛光不良、悬突，冠边缘不密合（C对）。③试冠、戴冠时对牙龈损伤。④嵌塞食物压迫。⑤倾斜牙、异位牙修复体未能恢复正常排列和外形。⑥龈沟内粘固剂残留（D对）。